大气中的NOₓ主要指
A. N₂O和NO
B. NO₂和NO
C. NO和N₂O₃
D. N₂O₅和NO₂
E. NO₃和N₂O

正确答案：B。NO₂和NO

解析：本题考查大气中的NOₓ。大气中的NOₓ主要指NO₂和NO（B对ACDE错）。